能改善稳定型心绞痛患者临床预后的是
A. 尿激酶
B. 阿司匹林
C. 速效救心丸
D. 硝酸甘油
E. 利多卡因

正确答案：B。阿司匹林

解析：稳定型心绞痛患者预防心肌梗死，改善预后，可选用阿司匹林（B对），该药物可通过抑制环氧化酶和血栓烷A2的合成达到抗血小板聚集的作用，从而防止血栓的形成，所有患者只要没有用药禁忌证都应该服用。尿激酶（P243）（A错）主要用于急性心肌梗死的溶栓治疗，速效救心丸（C错）和硝酸甘油（D错）可用于心绞痛发作时的紧急治疗，因其起效快，可迅速扩张冠脉。利多卡因（九版药理学P196）（E错）主要治疗室性心律失常，如心脏手术、心导管术、急性心肌梗死或强心苷中毒所致的室性心动过速或心室纤颤。后四种药物都不能改善稳定型心绞痛患者临床预后。